关于原发性三叉神经痛，下列哪项是错误的
A. 多为单侧发病
B. 可有“扳机点”存在
C. 疼痛呈阵发性、刀割样剧痛
D. 神经系统检查往往有阳性体征
E. 疼痛分布于三叉神经分布区域内

正确答案：D。神经系统检查往往有阳性体征

解析：原发性三叉神经痛患者无论病程长短，神经系统检查无阳性体征发现，仍保持罹患分支区域内的痛觉、触觉和温觉的感觉功能和运动支的咀嚼肌功能。只有在个别病例中有某个部位皮肤的敏感性增加。掌握“三叉神经痛”知识点。